患者陈某，男，30岁，孤身外出途中急诊需住院而无法凑足住院押金，医院如何处理才最符合医学伦理要求
A. 拒绝为患者作任何治疗
B. 令患者另找医院
C. 按救死扶伤的精神，免费为患者治疗
D. 按患者当前手头所有金钱最优化地制定治疗方案
E. 坚持医院的经济利益为重，交齐押金方可住院

正确答案：D。按患者当前手头所有金钱最优化地制定治疗方案